阴虚火旺患者舌色多见
A. 淡红舌
B. 绛舌
C. 青舌
D. 紫舌
E. 淡白舌

正确答案：B。绛舌

解析：久病阴虚火旺，或热病后期阴液耗损则见舌绛少苔或无苔，或有裂纹（B对）。淡红舌，舌色淡红润泽，常见于健康人；外感病见之，多属表证；内伤杂病见之，多病轻（A错）。全舌淡紫而无红色，称为青舌；深绛而色暗，称为紫舌；青紫舌主气血瘀滞（CD错）。淡白舌，比正常舌色浅淡；舌色白而几无血色者，称为枯白舌；主气血两虚、阳虚；枯白舌主亡血夺气（E错）。